治疗胁痛肝阴不足证，应首选
A. 沙参麦冬汤
B. 麦门冬汤
C. 益胃汤
D. 玉女煎
E. 一贯煎

正确答案：E。一贯煎

解析：胁痛肝阴不足证是由于肝郁日久化热，耗伤肝阴，或久病体虚，精血亏损，不能濡养肝络，治以养阴柔肝，代表方为一贯煎（E对）。沙参麦冬汤，其功用为甘寒养阴，润燥生津，可用于内伤咳嗽之肺阴亏虚证（A错）。麦门冬汤，其功用为滋阴养胃，降逆止呕，可用于呕吐之胃阴不足证(B错)。益胃汤，其功用为养胃生津，可用于呃逆之胃阴不足证（C错）。玉女煎，其功用为清胃滋阴，可用于中消、胃热炽盛证（D错）。